足厥阴肝经分布于内踝尖八寸以上的
A. 下肢内侧前缘
B. 下肢外侧前缘
C. 下肢内侧后缘
D. 下肢外侧中线
E. 下肢内侧中线

正确答案：E。下肢内侧中线

解析：十二经脉在四肢的分布规律是：阴经行于内侧面，阳经行于外侧面。其中，上肢内侧为太阴在前，厥阴在中，少阴在后；上肢外侧为阳明在前，少阳在中，太阳在后。下肢外侧为阳明在前（B错），少阳在中（D错），太阳在后；下肢内侧，内踝尖上八寸以下为厥阴在前，太阴在中，少阴在后；内踝尖上八寸以上则太阴在前（A错），厥阴在中（E对），少阴在后（C错）